男，60岁，腹泻、便秘交替，粪便带血6个月，体重减轻5Kg，查体：T36.5°C，P80次/分，R18次/分，BP120/80mm/Hg，双肺呼吸音清，未闻及干湿性啰音，心率80次/分，律齐，腹软，无压痛，血常规：Hb120g/L，WBC15.6×10⁹/L。N0.86。结肠镜检查于乙状结肠见溃疡性病灶，超声内镜提示病灶侵犯肠壁浆膜，肠周无肿大淋巴结，该病人TNM分期中T分期考虑为
A. T₃
B. T₀
C. T₄
D. T₁
E. T₂

正确答案：A。T₃

解析：老年男性患者，腹泻、便秘、粪便带血、体重减轻，结肠镜检查于乙状结肠见溃疡性病灶，超声内镜提示病灶侵犯肠壁浆膜，考虑诊断为结肠癌。TNM分期中T分期为T₃（A对）。